男，15岁，1小时前车祸伤，体检：呼吸38次/分，意识模糊，血压80/60mmHg，左下胸壁有一5cm长伤口，伤口有气泡溢出。腹部隆起不明显。诊断为开放性气胸，其纵隔表现应为
A. 纵隔无变化
B. 吸气时纵隔向左侧移位
C. 呼气时纵隔向左侧移位
D. 呼气时纵隔向右侧移位
E. 以上都不对

正确答案：C。呼气时纵隔向左侧移位

解析：开放性气胸，病理生理：伤侧胸膜腔负压消失，肺被压缩而萎陷。纵隔扑动：吸气时，健侧胸膜腔负压升高，与伤侧压力差增大，纵隔向健侧进一步移位；呼气时两侧胸膜腔压力差减小，纵隔移回伤侧，纵隔摆动影响静脉血流回心脏，引起循环功能严重障碍。残气对流：吸气时健侧肺扩张，吸进的气体不仅有来自从气管进入的外界空气，也有来自伤侧肺排出的含氧量低的气体；呼气时健侧肺呼出的气体不仅从上呼吸道排出体外，同时也部分进入伤侧肺。含氧量低的气体在两侧肺内重复交换，造成严重缺氧。掌握“气胸”知识点。